患者，女性，56岁。头痛，头晕2个月，并有时心悸，经检查：血压180/105mmHg，并有窦性心动过速，最好选用哪种治疗方案
A. 氢氯噻嗪﹢普萘洛尔
B. 氢氯噻嗪﹢可乐定
C. 硝苯地平﹢肼屈嗪
D. 硝苯地平﹢哌唑嗪
E. 卡托普利﹢肼屈嗪

正确答案：A。氢氯噻嗪﹢普萘洛尔